黄疸病人合并肿大而无触痛的胆囊时，最可能是
A. 急性胆囊炎
B. 慢性胆囊炎、胆囊积水
C. 胆囊颈部结石嵌顿
D. 中下段胆管癌
E. 胆总管下段结石

正确答案：D。中下段胆管癌

解析：胆管癌患者癌肿阻塞胆道，可出现黄疸。中下段胆管癌由于癌肿阻塞胆总管，导致胆囊胆汁淤积，使胆囊肿大。因胆囊本身并无病变，所以无触痛。所以，黄疸病人合并肿大而无触痛的胆囊时，最可能的是中下段胆管癌（D对）。急性胆囊炎症状主要是上腹部疼痛，10%～20%的病人可出现轻度黄疸，胆囊肿大者少见（A错）。慢性胆囊炎、胆囊积水病人常在饱餐、进食油腻食物后出现腹胀、腹痛，黄疸和胆囊肿大少见（B错）。胆囊颈部结石嵌顿通常表现为胆绞痛（C错）。胆总管下段结石可有较典型的Charcot三联征，即腹痛、寒战高热、黄疸，但胆囊肿大少见（E错）。